依照我国《人体器官移植条例》，下列可以为其直系血亲捐献肾脏的是
A. 27周岁的未婚男性
B. 35周岁的严重智力低下患者
C. 17周岁的健康中学生
D. 25周岁的乙肝患者
E. 22周岁的精神病患者

正确答案：A。27周岁的未婚男性

解析：《人体器官移植条例》规定，捐献人体器官的应当具有完全民事行为能力的公民，35周岁的严重智力低下患者（B错）、22周岁的精神病患者（E错）均不是具有完全民事行为能力者；活体器官捐献者需是年满18周岁公民，17周岁的健康中学生（C错）不符；活体器官的接受人限于活体器官捐献人的配偶、直系血亲或者三代以内旁系血亲，或者限于养父母和养子女之间、继父母与继子女之间因帮扶等形成亲情关系的人员，27周岁的未婚男性（A对）已满18周岁，且是直系血亲，当满足具有完全民事行为能力，则符合捐献肾脏条件。器官选择时应慎用乙型、丙型肝炎病毒感染者、吸毒者、有相关脏器病史者的器官，故25周岁的乙肝患者（D错）不宜采用。